下列不属于食物中毒特征的是
A. 食物中毒的发病必然与近期进食某种食物有关，凡是未进食这种食品的人一般不发病
B. 发病曲线呈现突然上升又迅速下降，无尾峰
C. 化学性食物中毒发病较细菌性食物中毒发病快
D. 大多数细菌性食物中毒以急性肠道症状为主要表现
E. 食物中毒具有较强的传染性

正确答案：E。食物中毒具有较强的传染性